中年人心理常见问题
A. 人际关系错综复杂
B. 家庭与事业的双趋冲突
C. 反应速度与记忆能力下降
D. 渴望健康与追求成就的矛盾
E. 以上说法均正确

正确答案：E。以上说法均正确

解析：中年人心理发展中的常见问题：①反应速度与记忆能力下降；②渴望健康与追求成就的矛盾；③人际关系错综复杂；④家庭与事业的双趋冲突。掌握“不同年龄阶段心理卫生”知识点。